女，16岁。被倒塌的房屋压伤后腹痛伴呕吐1小时。查体：P140次/分，R26次/分，BP80/54mmHg。神志清，痛苦面容，腹肌紧张，有压痛和反跳痛，移动性浊音（+），肠鸣音消失。若行急诊手术，原则上应首先探查
A. 空肠和回肠
B. 肝脏和脾脏
C. 结肠和直肠
D. 胃和大网膜
E. 十二指肠和胰腺

正确答案：B。肝脏和脾脏

解析：青少年女性患者，外伤后腹痛伴呕吐，P140次/分（正常为60～100次/分），BP80/50mmHg（正常为90～139/60～89mmHg，脉快、血压下降提示腹腔内出血），腹肌紧张，有压痛和反跳痛（腹膜刺激征），移动性浊音阳性（提示腹腔实质性脏器破裂出血），结合患者病史和临床表现，应考虑为闭合性腹部损伤伴腹腔脏器损伤。若行急诊手术，应对腹腔脏器进行系统、有序的探查，原则上应首先探查肝、脾（B对）等实质性脏器，同时探查胆囊、膈肌有无损伤，之后依次探查胃（D错）、十二指肠第一段、空肠、回肠（A错）、结直肠（C错）及其系膜、盆腔脏器、胃后壁和胰腺（E错），必要时切开后腹膜探查十二指肠二、三、四段。在术中发现出血性损伤或脏器破裂，应随时进行止血或夹住破口。